大柴胡汤中配伍大黄的主要用意是
A. 内泻热结
B. 活血祛痰
C. 和解清热
D. 泻火除湿
E. 缓急止痛

正确答案：A。内泻热结

解析：大柴胡汤可和解少阳，内泻热结。主治少阳阳明合病。方中重用柴胡为君药，配臣药黄芩和解清热，以除少阳之邪；轻用大黄配枳实以内泻阳明热结，行气消痞，亦为臣药（A对）。芍药柔肝缓急止痛，与大黄相配可治腹中实痛，与枳实相伍可以理气和血，以除心下满痛；半夏和胃降逆，配伍大量生姜，以治呕逆不止，共为佐药。大枣与生姜相配，能和营卫而行津液，并调和脾胃，功兼佐使。